T、B细胞定居、分化和增生的场所是
A. 骨髓
B. 淋巴结
C. 胸腺
D. 外周免疫器官
E. 脾

正确答案：D。外周免疫器官